日常咀嚼食物所需的咀嚼压力是
A. 10～20kg
B. 5～20kg
C. 20～30kg
D. 3～30kg
E. 30～40kg

正确答案：D。3～30kg

解析：本题考查咀嚼食物所需的咀嚼压力。日常咀嚼食物所需的咀嚼压力是3～30kg（D对）。实验表明，一般日常食物所需要的咀嚼压力为3～30kg。由此可以推知，肌肉、牙及其支持组织，尚有相当大的储备力量。这种储备力量的多少，有赖于牙及其支持组织的健康状况，这在临床上称为牙周潜力或牙周储备力。牙周潜力的存在是牙缺失后义齿修复的生理基础。义齿修复时利用基牙的牙周潜力，承担义齿人工牙所受到的（牙合）力。